终末消毒是指
A. 用化学、物理、生物等方法消除或杀灭外界环境中的致病性微生物的一种措施
B. 在没有发现明确传染源时，对可能受到病原微生物污染的场所和物品施行的消毒
C. 对现有或曾经有传染源存在的场所进行的消毒，属于防疫措施，其目的是消灭传染源排出的病原体
D. 当传染源还存在于疫源地时，对传染源的排泄物、分泌物或被污染的物品以及场所进行的及时消毒
E. 当传染源痊愈、死亡或离开后对疫源地所进行的彻底消毒，目的是完全消除传染源播散在外环境中的病原体

正确答案：E。当传染源痊愈、死亡或离开后对疫源地所进行的彻底消毒，目的是完全消除传染源播散在外环境中的病原体